男，65岁，患急性胰腺炎入院，出现多器官功能不全综合征，分析其发生机制，不属于重要损害因子的是
A. 细胞因子
B. 炎性介质
C. 生长因子
D. 全身炎性反应
E. 组织缺血—再灌注过程

正确答案：C。生长因子

解析：老年男性患者，患急性胰腺炎入院，胰腺发生严重炎症反应并进一步波及全身，导致多器官功能不全综合征。在炎症发生发展的过程中，大量活化的胰酶消化胰腺自身，损伤腺泡细胞，激活炎症反应的枢纽分子NF-kB，它的下游系列炎症介质（B对）（如活性氧及肿瘤坏死因子α、白介素-1等细胞因子（A对））增加血管通透性，导致大量炎性渗出。以上多种因素可以正反馈方式相互作用，使炎症逐级放大，当超过机体的抗炎能力时，炎症向全身扩展，出现全身炎性反应（D对），急性胰腺炎时胰腺发生微循环障碍，造成胰腺缺血、坏死，自由基大量形成，当恢复血液供应后，过量的自由基攻击重新获得血液供应的组织，形成组织缺血—再灌注过程（E对）。生长因子（C错，为本题正确答案）是一类多肽物质，主要是通过与特异的、高亲和的细胞膜受体结合，起调节细胞生长与其他细胞功能的作用。